医学道德教育的意义不包括
A. 有助于形成医务人员的内在品质
B. 有助于培养医务人员的人文素养和道德情操
C. 有助于促进医学科学工作发展
D. 是将医学道德原则和规范转化为内心信念的重要环节
E. 是确保维护社会公益的原则

正确答案：E。是确保维护社会公益的原则

解析：医学道德教育，是指在医学教育和医疗卫生实践中，遵循道德教育的基本规律，对医学生和医务人员系统地开展医学伦理精神传承、医学伦理文化培育、医学道德规范灌输以及如何转化为职业行为的教导和训练过程。目的是围绕业已成熟并不断创新的医学道德的文化、知识和实践体系，确立职业道德境界、有效激发职业情感、严格规范职业行为、培养良好职业习惯（E错，为本题正确答案）。